下列哪种因素可能使癌基因活化
A. 癌基因发生点突变
B. 正常基因不表达
C. 正常基因表达减弱
D. 抑癌基因表达增强
E. 细胞分化增加

正确答案：A。癌基因发生点突变